下列哪项不是紫外线的作用
A. 色素沉着作用
B. 杀菌作用
C. 红斑作用
D. 抗佝偻病作用
E. 镇静作用

正确答案：E。镇静作用

解析：本题考查紫外线的作用。紫外线具有色素沉着（A对）、红斑（C对）、抗佝偻病（D对）、杀菌（B对）和免疫增强作用。过强的紫外线可致日光性皮炎和光电性眼炎、甚至皮肤癌等；紫外线还与大气中的某些二次污染物形成有关，例如光化学烟雾和硫酸雾等。镇静作用（E错，为本题正确答案）是红外线的作用。